卵巢前缘
A. 与卵巢窝相依
B. 与小肠相邻
C. 游离
D. 借系膜连于子宫阔韧带
E. 与输卵管伞相接触

正确答案：D。借系膜连于子宫阔韧带

解析：卵巢外侧面与卵巢窝相依（A错），内侧面朝向盆腔，与小肠相邻（B错），卵巢的后缘游离（C错），前缘借系膜连于子宫阔韧带（D对），输卵管伞盖在卵巢的上面（E错）。